女，50岁。因患短肠综合症，予全胃肠外营养（TPN）治疗。应用一周时，病人出现昏迷，但尿内无酮体。病人既往曾有空腹血糖高（11mmol／L）。此病的预防主要是
A. 开始一周内注意葡萄糖输注的浓度、速度和与胰岛素的比例
B. 加强保肝
C. 加强导管护理、无菌操作
D. 纠正水和电解质紊乱，预防酸中毒发生
E. 保护肾功能

正确答案：A。开始一周内注意葡萄糖输注的浓度、速度和与胰岛素的比例

解析：预防高渗性非酮性昏迷的发生，应注意葡萄糖输注的浓度不宜过高、速度不宜过快，与胰岛素的比例合适（A对）。加强导管护理、无菌操作（C错）是导管感染败血症的预防措施。加强保肝（B错）、保护肾功能（E错）、纠正水和电解质紊乱，预防酸中毒发生（D错）与高渗性非酮性昏迷无关。